可导致肝坏死的对乙酰氨基酚的代谢物是
A. 对乙酰氨基酚硫酸酯
B. 对乙酰氨基葡萄糖醛酸酯
C. N-乙酰亚胺醌
D. 对氨基酚
E. 乙酸

正确答案：C。N-乙酰亚胺醌

解析：本题考查对乙酰氨基酚。可导致肝坏死的对乙酰氨基酚的代谢物是N-乙酰亚胺醌（C对）。对乙酰氨基酚主要在肝脏代谢，大部分与葡萄糖醛酸及硫酸结合，从尿中排泄。少量生成有毒的N-羟基乙酰氨基酚，进一步转化成毒性代谢物N-乙酰亚胺醌。在正常情况下，N-乙酰基亚胺醌可与肝内的谷胱甘肽结合而解毒。若应用本品过量时，因谷胱甘肽被耗尽，代谢物即与肝蛋白结合，引起肝组织坏死。对乙酰氨基酚硫酸酯（A错）是经肾脏排出的代谢物，无毒性。对乙酰氨基酚葡萄糖醛酸结合物（B错）为对乙酰氨基酚与葡萄糖醛酸结合的产物，可经肾排泄，无毒。对氨基酚（D错）毒性较大，是合成过程中乙酰化不完全或贮藏过程中水解引入的杂质，非代谢产物。